女，2.5岁。高烧3天，口腔溃疡病2天。啼哭，流涎，拒食。体检发现患儿全口牙龈红肿，上腭黏膜可见密集的针头大小透明水疱，部分已破溃为浅表溃疡，周围黏膜充血水肿广泛。本病例最可能的诊断为
A. 鹅口疮
B. 口蹄疫
C. 贝氏口疮
D. 口炎型口疮
E. 疱疹性龈口炎

正确答案：E。疱疹性龈口炎

解析：本题考查原发性疱疹性龈口炎的临床表现。疱疹性龈口炎是由Ⅰ型单纯疱疹病毒引起的口腔病损，以6个月至2岁婴幼儿最多见，主要分为前驱期、水疱期、糜烂期和愈合期。根据病例描述，高烧3天，啼哭，流涎，拒食，全口牙龈红肿（前驱期），上腭黏膜可见密集的针头大小透明水疱，部分已破溃为浅表溃疡，周围黏膜充血水肿广泛（水疱期），结合患儿年龄，最可能的诊断为疱疹性龈口炎（E对）。口蹄疫（B错）以手、足和口腔黏膜疱疹或溃破后形成溃疡为主要临床特征，病例中未描述手、足的症状，故口蹄疫的可能性较低。鹅口疮（A错）为新生儿的念珠菌性口炎，损害区主要表现为黏膜充血，有散在的色白如雪的柔软小斑点。贝氏口疮（C错）位于上腭黏膜，表现为圆形或椭圆形溃疡，左右对称，无全身症状，多有局部刺激因素。口炎型口疮（D错）是直径较小，数目较多，散在分布的溃疡，不是水疱，且多发于成年女性。